牙本质肩领的高度应尽量不小于
A. 1.5mm
B. 0.5mm
C. 1.0mm
D. 3.0mm
E. 2.0mm

正确答案：A。1.5mm

解析：本题考查桩核冠修复要求。牙本质肩领的高度应尽量不小于1.5mm（A对）。桩核冠修复的牙体预备要求磨除薄弱牙体组织，去除无支持的薄壁弱尖，平整根面剩余牙体组织，确定最终边缘线，保证牙本质肩领处牙体厚度不小于1mm，高度不小于1.5mm。